关于子宫内膜的周期性变化，错误的是
A. 孕激素使增生期子宫内膜转化为分泌期子宫内膜
B. 功能层剥脱伴子宫出血，形成月经
C. 子宫内膜有基底层和功能层
D. 基底层是孕卵种植部分
E. 功能层受卵巢激素影响而呈周期性变化

正确答案：D。基底层是孕卵种植部分

解析：子宫内膜分为功能层或基底层（C对）。功能层是胚胎植入的部分（D错，为本题正确答案），受卵巢性激素的调节呈现周期性变化（E对），若未受孕，功能层坏死脱落形成月经（B对）。基底层在月经后再生并修复子宫内膜创面，重新形成子宫内膜功能层。一个正常的月经周期以28日为例，其组织学变化分为3期，增殖期、分泌期和月经期；孕激素可使增生期子宫内膜转化为分泌期子宫内膜（A对）。